下列不属于疫源地消灭条件的是
A. 患者已经离开疫源地或不再排出病原体
B. 对病人家居环境实施终末消毒
C. 对疫源地实施终末消毒
D. 对疫源地连续观察了平均潜伏期未发现新患者
E. 对疫源地连续观察了一个最长潜伏期未发现新患者

正确答案：D。对疫源地连续观察了平均潜伏期未发现新患者